以下关于无牙颌副承托区的描述中，哪一项不正确
A. 副承托区指上下颌牙槽嵴的唇颊和舌腭侧（不包括硬区）
B. 副承托区和主承托区之间无明显界线
C. 副承托区支持力较差，不能承受较大的咀嚼压力
D. 此区骨面上有黏膜、黏膜下层，还有肌附着点
E. 此区黏膜与骨面贴合紧密，黏膜稳固不动，有利于义齿固位

正确答案：E。此区黏膜与骨面贴合紧密，黏膜稳固不动，有利于义齿固位

解析：本题考查无牙颌的功能分区-副承托区。副承托区不能承受较大的咀嚼压力，但是可抵抗义齿所受的水平向压力，有利于义齿稳定；固位主要靠边缘封闭区，此区黏膜与骨面贴合紧密，黏膜稳固不动，有利于义齿固位（E错，为本题的正确答案）。副承托区指上下颌牙槽嵴的唇颊和舌腭侧（不包括硬区）（A对）。副承托区和主承托区是相互延续的，无明显界线（B对）。副承托区黏膜为附着黏膜向非附着黏膜过渡，上皮角化程度低，黏膜下层疏散，黏膜下可含有脂肪、腺体甚至有肌纤维附着点（D对），所以支持力较差，不能承受较大的咀嚼压力（C对）。